酸性食品抑制多种微生物的pH范围是
A. pH4以下
B. pH4.5以下
C. pH5以下
D. pH5.5以下
E. pH6以下

正确答案：B。pH4.5以下